执业药师应对处方进行用药适宜性审核，如发现有不合理联用的药组，应建议纠正的是
A. 人参养荣丸与归脾丸
B. 复方丹参滴丸与速效救心丸
C. 四神丸与附子理中丸
D. 脑立清胶囊与六味地黄丸
E. 二陈丸与平胃散

正确答案：B。复方丹参滴丸与速效救心丸

解析：本题考查的是中成药联用的配伍禁忌。执业药师应对处方进行用药适宜性审核，如发现有不合理联用的药组，应建议纠正的是复方丹参滴丸与速效救心丸（B对）。含有毒药物中成药的联用：数种功效相似的中成药联用，在各自制剂的组成中，往往有一种或几种相同的药味。因此，联用将会增加某一味或几味药的剂量。如大活络丸与天麻丸合用，两者均含附子；朱砂安神丸与天王补心丸合用，两者均含朱砂，均会增加有毒药味的服用量，加大患者产生不良反应的危险性。故在使用时应考虑药物“增量”的因素。再如复方丹参滴丸和速效救心丸同属气滞血瘀型用药，其处方组成与功效基本相似，而且这一类的药物多数含有冰片，由于冰片药性寒凉，服用剂量过大易伤人脾胃，导致胃痛胃寒，故不可过量使用，在临床应用中使用其中一种即可。因此中成药之间的联合用药。尤其是几种含有毒成分或相同成分的中成药联合应用时，应注意有毒成分或相同成分的“叠加”，以免引起不良反应。人参养荣丸与归脾丸（A错）同用可明显增强补益心脾、益气养血、安神止痉的功效，治疗心悸失眠、眩晕健忘。四神丸与附子理中丸（C错）合用，可以增强温肾运脾、涩肠止泻的功效，治疗脾肾阳虚之五更泄泻。脑立清胶囊与六味地黄丸（D错）合用，用于高血压病证属肝肾阴虚、风阳上扰者。二陈丸与平胃散（E错）同用，以二陈丸燥湿化痰为主方治疗湿痰咳嗽，而脾为生痰之源，辅以平胃散同用，燥湿健脾，可明显增强二陈丸燥湿化痰之功。